神经细胞动作电位的幅度接近于
A. Na⁺平衡电位
B. K⁺平衡电位
C. Na⁺平衡电位与K⁺平衡电位之和
D. Na⁺平衡电位与K⁺平衡电位之差
E. 超射值

正确答案：C。Na⁺平衡电位与K⁺平衡电位之和